有关mRNA结构的叙述，正确的是
A. 5'端有多聚腺苷酸帽子结构
B. 3'端有甲基化鸟嘌呤尾结构
C. 链的二级结构为单链卷曲和单链螺旋
D. 链的局部可形成双链结构
E. 三个相连核苷酸组成一个反密码子

正确答案：D。链的局部可形成双链结构